俞、胆俞外，还可用
A. 胆囊穴、日月、期门
B. 阑尾穴、中脘、足三里
C. 胆囊穴、日月、京门
D. 阑尾穴、中脘、天枢
E. 胆囊穴、梁丘、太冲

正确答案：A。胆囊穴、日月、期门

解析：题干描述的为胆绞痛的症状，胆绞痛的主穴、日月、期门、胆俞、肝俞、胆囊穴、阳陵泉”（A对）。阑尾穴、中脘、足三里可治疗阑尾炎（B错）。京门主治小便不利、水肿等水液代谢失调的病证，腹胀、肠鸣等胃肠疾病，腰痛、胁痛，不用于治疗胆绞痛（C错）。阑尾穴治疗阑尾炎，天枢用于治疗腹痛、腹泻等胃肠疾病，月经不调等妇科疾病（D错）。梁丘主治急性胃病，下肢病证，乳疾；太冲理肝气，解肝郁，皆不治疗胆绞痛（E错）。